心肌向心性肥大的本质是：
A. 心肌细胞增生
B. 肌节的并联性增生
C. 肌节的串联性增生
D. 心肌纤维长度加大
E. 以上都不是

正确答案：B。肌节的并联性增生

解析：心肌肥大分为向心性肥大和离心性肥大。向心性肥大时，长期过度的后负荷使心脏收缩期室壁张力增加，刺激心肌肌节并联性增生（B对），心肌细胞增粗。离心性肥大时，长期过度的前负荷使心脏舒张期室壁张力增加，刺激心肌肌节串联性增生（C错），心肌纤维长度加大（D错），虽然心肌细胞增长导致的心腔容积增大又可刺激心肌肌节并联性增生，但离心性肥大的本质应该是肌节的串联性增生。心肌细胞增生（A错）与心肌肥大有关，但不是向心性肥大的本质。